下列哪种传染病不可能经胎盘传播
A. 风疹
B. 乙肝
C. 艾滋病
D. 麻疹

正确答案：D。麻疹

解析：本题考查经胎盘传播的疾病。经胎盘传播是指有些病原体可通过胎盘屏障，受感染的孕妇经胎盘血液将病原体传给胎儿引起宫内感染。如风疹（A对）病毒、艾滋病（C对）病毒和乙型肝炎（B对）病毒等。麻疹（D错，为本题正确答案）主要通过飞沫和直接接触传播。